男，8个月。持续高热频咳，精神萎靡5天，近2天气促加重，今抽搐3次全身性发作嗜睡。查体：体温40℃，呼吸54次/分，心率148次/分，双肺少量中细湿啰音，左下肺闻及管状呼吸音，肝肋下1cm，白细胞计数不高。X线显示大小不等的片状病灶或融合性病灶，以两肺下野及右上肺多见。最有可能的诊断是
A. 急性咽喉炎
B. 肺炎链球菌肺炎
C. 支原体肺炎
D. 腺病毒肺炎
E. 金黄色葡萄球菌肺炎

正确答案：D。腺病毒肺炎

解析：患儿白细胞不高，可排除细菌性感染（ABE错）；支原体肺炎一般全身症状不重，且有剧烈咳嗽，与本例不符（C错）。腺病毒肺炎的特点为起病急骤、高热持续时间长、中毒症状重、啰音出现较晚、X线改变较肺部体征出现早（D对）。